安全系数可用于推算安全限值，不正确的叙述为
A. 设安全系数是由于动物实验结果外推到人的不确定性
B. 安全系数一般设为100
C. 适用于系统毒物，发育毒物
D. 适用于遗传毒致癌物和致突变物
E. 安全限值=NOAEL／安全系数

正确答案：D。适用于遗传毒致癌物和致突变物